铅可引起
A. 再生障碍性贫血
B. 低色素性贫血
C. 溶血性贫血
D. 缺铁性贫血
E. 大细胞性贫血

正确答案：B。低色素性贫血

解析：本题考查铅对血液系统的损害。对于血液系统而言，铅干扰卟啉代谢，影响血红素合成可引起低色素性贫血（B对ACDE错），还会因为骨髓内幼红细胞代偿性增生致血中点彩红细胞和网织红细胞增多；铅可抑制红细胞膜Na+,K+—ATP酶的活性，使红细胞内钾离子逸出导致红细胞膜崩溃而溶血；铅与红细胞表面的磷酸盐结合可生成不溶性磷酸盐使红细胞脆性增加导致溶血。